下列缓（控）释制剂中，控释效果最好的是
A. 水不溶性骨架片
B. 亲水凝胶骨架片
C. 水不溶性薄膜包衣片
D. 渗透泵片
E. 生物黏附片

正确答案：D。渗透泵片

解析：本题考查控释制剂。渗透泵片（D对）利用渗透泵原理制成，能均匀恒速释放药物，其释药速率不受胃肠道可变因素如蠕动、pH、胃排空时间等因素影响，控释效果好。